妊高征孕妇头痛剧烈伴呕吐时首选药物是
A. 硫酸镁静脉滴注
B. 哌替啶肌内注射
C. 肼苯达嗪静脉滴注
D. 甘露醇快速静滴
E. 阿托品静脉推注

正确答案：D。甘露醇快速静滴

解析：妊高征孕妇头痛剧烈伴呕吐提示颅内压增高，应首选甘露醇快速静滴（D对）以迅速降低颅内压。硫酸镁静脉滴注（P71）（A错）可控制子痫抽搐及预防子痫前期发展为子痫；肼苯达嗪静脉滴注（八年制妇产科学第2版P83）（C错）能扩张血管快速降压，但此妊高征孕妇出现了颅内压增高，当务之急是降低颅内压，以防发生脑血管意外。哌替啶肌内注射（P70）（B错）有助于解痉降压，控制子痫抽搐，但会使血压急剧下降，导致肾及子宫胎盘血供减少，导致胎儿缺氧，仅用于硫酸镁治疗效果不佳者。阿托品静脉推注（P384）（E错）能抑制胆碱能纤维，拮抗迷走神经过度兴奋，主要用于治疗人工流产综合反应（指手术时疼痛或局部刺激，使受术者在术中或术毕出现恶心、呕吐、头晕、心动过缓、心律不齐、面色苍白、头晕、胸闷，严重者甚至出现血压下降、晕厥、抽搐等迷走神经兴奋等症状）严重者。